A型性格的特征是
A. 雄心壮志
B. 喜欢竞争
C. 雄心壮志、喜欢竞争、性情急躁、缺乏耐心
D. 雄心壮志、喜欢竞争、性情急躁、缺乏耐心、容易激动
E. 做事不慌不忙

正确答案：D。雄心壮志、喜欢竞争、性情急躁、缺乏耐心、容易激动